治疗哮喘发作期寒证，应首选
A. 三子养亲汤
B. 小青龙汤
C. 清金化痰汤
D. 涤痰汤
E. 麻杏石甘汤

正确答案：B。小青龙汤

解析：小青龙汤解表散寒，温肺化饮，主治外寒内饮证，适用于哮喘发作期寒证表寒内饮，加苏子，白前，杏仁，橘皮等化痰利气（B对）。三子养亲汤功用温肺化痰，降气消食，主治痰壅气逆食滞证（A错）。清金化痰丸功用清肺化痰，适用于痰热壅肺，咳嗽，咳痰黄稠，舌质红，苔黄腻等症（C错）。涤痰汤功用涤痰开窍，主治中风痰迷心窍证（D错）。麻杏石甘汤功用辛凉疏表，清肺平喘，主治外感风邪，邪热壅肺证（E错）。